女，55岁。进行性呼吸困难2个月，心界向两侧扩大，心率120次/分。Ewart征阳性。应立即采取的措施是
A. 抗生素治疗
B. 心包穿刺抽液
C. 抗结核治疗
D. 心包切除
E. 心脏移植

正确答案：B。心包穿刺抽液

解析：患者中老年女性，有进行性呼吸困难症状（肺淤血表现），心界向两侧扩大（心包积液时可见心影向两侧增大呈烧瓶状），心率120次/分（正常值60～100次/分，提示窦性心动过速），Ewart征（即心包积液征，为大量心包积液时的特异体征）阳性，结合患者的临床表现和典型体征，该患者考虑诊断为心包积液引起心脏压塞。此时应立即采取的措施是心包穿刺抽液（B对），迅速解除心脏压塞。抗生素治疗（A错）、抗结核治疗（C错）主要针对心包积液病因的治疗，主要在疾病早期使用，本例患者已出现心脏压塞症状，故不适合药物治疗。心包切除（P307）（D错）常用于缩窄性心包炎的治疗；心脏移植（P174）（E错）是治疗顽固性心力衰竭的方法，两者一般不用于心脏压塞的治疗。